水不溶性包衣材料是
A. CAP
B. EC
C. PEG400
D. HPMC
E. CCMC-Na

正确答案：B。EC

解析：本题考查片剂的包衣。EC（乙基纤维素）（B对）不溶于水，为水不溶性包衣材料；CAP（醋酸纤维素酞酸酯）（A错）为肠溶型包衣材料；HPMC（D错）为胃溶型包衣材料；CCMC-Na（交联羧甲基纤维素钠）（E错）为崩解剂。